不属于心理健康标准的是
A. 身体强壮
B. 智力正常
C. 人际和谐
D. 情绪良好
E. 人格完整

正确答案：A。身体强壮

解析：心理健康的标准有5条标准值得重视，这就是：智力正常、情绪良好、人际和谐、社会适应、人格完整。掌握“心理健康概述”知识点。